最易引起病毒性心肌炎的病毒是
A. 脊髓灰质炎病毒
B. 柯萨奇病毒A组
C. 柯萨奇病毒B组
D. 埃可病毒
E. 肠道病毒70型

正确答案：C。柯萨奇病毒B组

解析：柯萨奇病毒A组主要引起肌肉松弛麻痹，多数不能在培养细胞中生长；B组病毒引起肌肉痉挛型麻痹，能在多种培养细胞中生长。掌握“胃肠道病毒”知识点。